最易引起嵌顿的腹外疝是
A. 股疝
B. 小儿脐疝
C. 白线疝
D. 切口疝
E. 腹股沟直疝

正确答案：A。股疝

解析：疝囊通过股环、经股管突出的疝称为股疝。由于股管几乎是垂直的，疝块在卵圆窝处向前转折时形成一锐角，且股环本身较小，周围又多坚韧的韧带，因此股疝容易嵌顿。腹外疝最易发生嵌顿的是股疝（A对），约占所有嵌顿疝的60%，其次为斜疝。直疝（E错）、切口疝（D错）、小儿脐疝（B错）均很少发生嵌顿。白线疝（P317）（C错）也称上腹疝，指发生于腹壁正中线（白线）处的疝，很少发生嵌顿。